应当定期公告药品质量抽查检验结果的是
A. 地方人民政府和药品监督管理部门
B. 国务院或者省级人民政府的药品监督管理部门
C. 药品监督管理部门及其设置的药品检验机构
D. 药品监督管理部门及其设置的药品检验机构的工作人员
E. 药品生产、经营企业和医疗机构的药品检验机构或者人员

正确答案：B。国务院或者省级人民政府的药品监督管理部门

解析：本题考查药品监督管理。应当定期公告药品质量抽查检验结果的是国务院或者省级人民政府的药品监督管理部门（B对）。药品质量公告是指由国务院和省级药品监督管理部门向公众发布的有关药品质量抽查检验结果的通告。《药品管理法》第101条规定，国务院和省、自治区、直辖市人民政府的药品监督管理部门应当定期公告药品质量抽查检验的结果；公告不当的，应当在原公告范围内予以更正。药品质量公告是药品监督管理的一项重要内容，也是药品监督管理部门的法定义务，药品抽查检验的结果应当依法向社会公告。地方人民政府和药品监督管理部门（A错）不得以要求实施药品检验、审批等手段限制或者排斥非本地区药品生产企业依照本法规定的药品进入本地区。药品监督管理部门及其设置的药品检验机构（C错）不得参与药品生产经营活动，不得以其名义推荐或者监制、监销药品。药品监督管理部门及其设置的药品检验机构的工作人员（D错）不得参与药品生产经营活动。药品生产、经营企业和医疗机构的药品检验机构或者人员（E错）应当接受当地药品监督管理部门设置的药品检验机构的业务指导。